木瓜的主治病证是
A. 湿疹瘙痒
B. 吐泻转筋
C. 胃阴虚证
D. 风湿热痹
E. 跌打损伤

正确答案：B。吐泻转筋

解析：本题考查的是木瓜的主治病证。木瓜的主治病证是吐泻转筋（B对）。木瓜：【主治病证】（1）风湿痹痛，筋脉拘挛，脚气肿痛。（2）湿浊中阻所致吐泻转筋。（3）津亏食少（消化不良）证。豨莶草：【主治病证】（1）风湿痹痛，肢体麻木。（2）中风手足不遂。（3）痈肿疮毒，湿疹瘙痒（A错）。（4）高血压病。胃阴虚证为南沙参的主治病证。南沙参：【主治病证】（1）肺热燥咳有痰，阴虚劳嗽咯血。（2）气阴两伤之舌干口渴。南沙参主清肺养阴、益胃生津，兼益气、祛痰，善治肺胃阴虚（C错）有热诸证，兼气虚或夹痰者尤宜。秦艽：【主治病证】（1）风湿热痹（D错），风寒湿痹，表证夹湿。（2）骨蒸潮热。（3）湿热黄疸。伸筋草：【主治病证】（1）风湿痹痛，关节酸痛，屈伸不利。（2）跌打损伤（E错）。